血中补体水平下降一般不见于
A. 急进性肾小球肾炎
B. 膜性肾炎
C. 系膜増生性肾小球肾炎
D. 狼疮肾炎
E. 急性肾小球肾炎

正确答案：C。系膜増生性肾小球肾炎

解析：急性肾小球肾炎（E对）、急进性肾小球肾炎（A对）主要是由β-溶血性链球菌感染后所诱发的免疫反应引起，诱发免疫反应后可通过IgG及C3等循环免疫复合物沉积于肾小球致病，导致血中补体水平下降。系膜增生性肾小球肾炎（C错，为本题正确答案）主要以IgA、IgG或IgM沉积导致系膜细胞和系膜基质弥漫增生为主，血中补体水平一般正常。七、八版内科学关于膜性肾炎、狼疮肾炎血清补体水平未作明确说明。